6岁的娟娟今年9月入学成了一名小学生。上学的第1周，她总是在课堂上低头玩弄小手绢，老师便不断提醒她，“娟娟，抬头看黑板”。第2周娟娟就能认真听讲了。可是到了学期末，她时常在课堂上做小动作，学习效率降低。老师的提醒使娟娟很快适应了课堂学习，是老师应用了大脑皮层功能活动特征的
A. 始动调节
B. 动力定型
C. 优势法则
D. 保护性抑制
E. 镶嵌式活动

正确答案：B。动力定型